红霉素的抗菌作用机制是
A. 抑制细菌细胞壁的合成
B. 抑制DNA的合成
C. 与30S亚基结合，抑制蛋白质合成
D. 与50S亚基结合，抑制蛋白质合成
E. 抑制二氢叶酸合成酶

正确答案：D。与50S亚基结合，抑制蛋白质合成

解析：本题考查药物的作用机制。红霉素的抗菌作用机制是与50S亚基结合，抑制蛋白质合成（D对）。红霉素是大环内酯类抗菌药的代表药物，其作用机制是与50S亚基结合，竞争性阻断了肽链延伸过程中的肽基转移作用与（或）移位作用，抑制蛋白质合成。